根据蛋白尿的发生机制，尿蛋白可分为五类，下列哪一类是错误的
A. 肾小球性蛋白尿
B. 肾小管性蛋白尿
C. 溢出性蛋白尿
D. 分泌性蛋白尿
E. 假性蛋白尿

正确答案：E。假性蛋白尿

解析：根据蛋白尿的发生机制，蛋白尿一般分为生理性蛋白尿、肾小球性蛋白尿（A对）、肾小管性蛋白尿（B对）、溢出性蛋白尿（C对）（八版诊断学还包括：分泌性蛋白尿（D对）即组织性蛋白尿）。假性蛋白尿（E错，为本题正确答案）是相对蛋白尿的临床意义而言，与发生机制无关，是由于尿中混有大量血、脓、黏液等成分而导致蛋白定性实验阳性，一般不伴有肾脏的损害，经治疗后很快恢复正常。肾小球性蛋白尿（A对）是由各种原因导致肾小球滤过膜通透性增加及电荷屏障受损，血浆蛋白大量滤入原尿，超过肾小管重吸收能力引起的蛋白尿。肾小管性蛋白尿（B对）是肾小管结构或功能受损，对正常滤过的小分子量蛋白质重吸收障碍，导致蛋白质从尿中排出增多形成的蛋白尿。溢出性蛋白尿（C对）是因血浆中出现异常增多的低相对分子质量蛋白质，超过肾小管重吸收能力所致的蛋白尿。分泌性蛋白尿（D对）是指肾小管分泌蛋白增多所致的蛋白尿。